升结肠癌主要临床表现
A. 肠梗阻
B. 便秘
C. 便血
D. 腹痛
E. 贫血

正确答案：E。贫血

解析：升结肠属于右侧结肠，腔大、壁薄。右侧结肠癌以隆起型病变多见，癌肿向肠腔内发展可长至较大，易导致肿瘤远端缺血、出血，临床上即表现为贫血（E对）。肠梗阻（A错）、便秘（B错）、便血（C错）属于左侧结肠癌的主要表现。腹痛（D错）可见于左、右结肠癌，属于一般临床表现。